乳腺与胸筋膜的关系是
A. 乳腺位于胸筋膜的深面
B. 乳腺位于胸筋膜的表面
C. 胸筋膜包绕乳腺
D. 胸筋膜包绕乳腺小叶
E. 胸筋膜固定乳房悬韧带

正确答案：B。乳腺位于胸筋膜的表面

解析：乳腺位于胸筋膜的表面（B对），胸壁浅筋膜包裹乳腺，在浅层连于皮肤形成乳房悬韧带（CD错）。